沙门菌引起的伤寒首选
A. 古霉素
B. 环丙沙星
C. 莫西沙星
D. 氟喹诺酮类
E. 左氧氟沙星

正确答案：D。氟喹诺酮类

解析：肠道感染与伤寒：志贺菌引起的急、慢性菌痢和中毒性菌痢，以及鼠伤寒沙门菌、猪霍乱沙门菌、肠炎沙门菌引起的胃肠炎。对沙门菌引起的伤寒或副伤寒，应首选氟喹诺酮类或头孢曲松。掌握“喹诺酮类”知识点。